可作为片剂中的助流剂的是
A. 山梨酸
B. 羟丙基甲基纤维素
C. 甲基纤维素
D. 微粉硅胶
E. 聚乙二醇400

正确答案：D。微粉硅胶

解析：本题考查片剂的常用辅料。按其作用不同，润滑剂可分为三类：助流剂、抗黏剂和润滑剂（狭义）。其中助流剂主要用于增加颗粒的流动性，改善颗粒的填充状态。一般将具有上述任何一种作用的辅料都称为润滑剂。常用的有硬脂酸镁、微粉硅胶（D对）、滑石粉、氢化植物油、聚乙二醇类（PEG4000、PEG6000）、月桂醇硫酸钠（镁）等。山梨酸（A错）为液体制剂中常用的防腐剂。羟丙基甲基纤维素（HPMC）（B错）和甲基纤维素（C错）为片剂常用的黏合剂。聚乙二醇400（E错）为液体制剂常用的保湿剂、增溶剂。